女婴，9个月。腹泻4天，约10次/日，呈稀水样，伴呕吐，每天2～3次，尿量减少。查体：皮肤干，弹性差，眼窝、前囟凹陷，心音低钝。最重要的处理措施是
A. 控制感染
B. 给予助消化药
C. 给予肠道微生态制剂
D. 纠正水电解质紊乱
E. 给予止吐药

正确答案：D。纠正水电解质紊乱

解析：本例患儿腹泻4天，约10次/日，呈稀水样，伴呕吐，每天2-3次，尿量减少，皮肤干，弹性差，眼窝、前囟凹陷，心音低钝，应诊断为中度脱水，小儿的水电解质、酸碱及食物成分按单位体重的进出量大，尤其是婴儿在生后数月内肾功能不如成人健全，常不能抵御及纠正水或酸碱平衡紊乱，其调节功能极易受疾病和外界环境的影响而失调，故患儿有脱水症状，应及时纠正水电解质紊乱（D对）。控制感染（A错）、给予肠道微生态制剂（C错）均为病原体感染性腹泻的一般治疗方法，给予助消化药（B错）用于治疗消化不良，止吐药（E错）副作用较大，应权衡后使用。